属妊娠慎用的成药有
A. 伤湿止痛膏
B. 乳癖消片
C. 安宫牛黄丸
D. 三妙丸
E. 天麻丸

正确答案：A、B、C、D、E。伤湿止痛膏；乳癖消片；安宫牛黄丸；三妙丸；天麻丸